属于烷化剂抗癌药物的是
A. 卡铂
B. 环磷酰胺
C. 氟尿嘧啶
D. 多柔比星
E. 长春新碱

正确答案：B。环磷酰胺